佝偻病活动早期
A. 血清钙正常，血清磷明显降低
B. 血清钙磷均降低
C. 血清钙磷正常
D. 血清钙磷低
E. 血清钙磷乘积为30～40

正确答案：E。血清钙磷乘积为30～40

解析：本题考查维生素D缺乏性佝偻病活动早期的血生化特征。维生素D缺乏性佝偻病是因为缺乏维生素D导致体内钙吸收不良，钙磷代谢紊乱，而引起的一系列慢性疾病。在佝偻病活动早期血清钙磷乘积为30～40（E对ABCD错）。